孤束核接受的纤维来自
A. III、VII、X
B. III、V、VII
C. VII、VIII、IX
D. VII、IX、X
E. IX、X、XI

正确答案：D。VII、IX、X

解析：孤束核位于延髓内界沟外侧，迷走神经背核的腹外侧，上端可达脑桥下端，下端至内侧丘系交叉平面。孤束核上部（味觉核）为特殊内脏感觉核，接受经面神经（第VII对脑神经）、舌咽神经（第IX对脑神经）和迷走神经（第X对脑神经）（D对）传入的味觉初级纤维；下部（心-呼吸核）为一般内脏感觉核，主要接受经舌咽神经和迷走神经传入的一般内脏感觉初级纤维。